男，10个月。牛奶喂养，面色苍白2个月，烦躁，肝肋下2cm，脾肋下触及。血象：血红蛋白80g/L，红细胞3.6×10¹²/L，网织红细胞0.01，外周血涂片红细胞大小不等，中心淡染，初步诊断是
A. 营养性巨幼红细胞性贫血
B. 地中海贫血
C. VitB₆缺乏性贫血
D. 再生障碍性贫血
E. 营养性缺铁性贫血

正确答案：E。营养性缺铁性贫血

解析：10个月男婴儿（缺铁性贫血多见年龄），牛奶喂养（缺铁性贫血诱因），近两个月面色苍白，烦躁（缺铁性贫血一般表现），肝肋下2cm，脾肋刚触及（髓外造血表现），Hb80g/L（正常值大于110g/L），RBC3.6×10¹²/L（正常值4×10¹²/L），网织红细胞0.01（正常值0.01），血涂片可见RBC大小不等，中心淡染区扩大（缺铁性贫血外周血涂片表现），根据患者的临床表现和实验室检查，应考虑的诊断是缺铁性贫血（E对）。婴儿期体格生长十分迅速，需大量各种营养素满足其生长，但婴儿的消化功能尚未成熟，如果加辅食不当易发生消化紊乱和营养不良等疾病很容易发生缺铁性贫血。营养性巨幼红细胞贫血（P359）（A错）主要是由于维生素B₁₂和（或）叶酸缺乏所致的一种大细胞性贫血，其临床突出表现为患儿有神经精神症状，如烦躁不安、易怒、表情呆滞、目光发直等，外周血象结果呈大细胞性贫血面色苍黄，且伴有智力低下。地中海贫血（B错）的患儿多有阳性家族史，其血象呈小细胞低色素性贫血，红细胞大小不等，中央浅染区扩大，出现异形、靶形、碎片红细胞和有核红细胞等，网织红正常或增高。维生素B₆贫血可由皮炎等维生素B₆缺乏症状，表现为食欲下降、骨短促和神经症状等，贫血为小细胞低色素性贫血，骨髓铁幼粒细胞增多，血清铁和运铁蛋白饱和度增高，再生障碍性贫血（D错）表现为发热、贫血和出血，肝、脾、淋巴结不肿大，血象呈全血细胞减少，骨髓有核细胞增生低下，无幼稚白细胞增生。